不属于白斑的病理改变的是
A. 棘层增生
B. 粒层明显
C. 主要表现为上皮增生
D. 有非典型性细胞
E. 临床和病理上都不能诊断为其他疾病

正确答案：D。有非典型性细胞

解析：本题考查口腔白斑、红斑病。口腔白斑病（oral leukoplakia，OLK）是发生于口腔黏膜上以白色为主的损害，不能擦去，也不能以临床和组织病理学的方法诊断为其他可定义的损害（E对），属于癌前病变或潜在恶性疾患范畴，不包括吸烟、局部摩擦等局部因素去除后可以消退的单纯性过角化症。白斑主要表现为上皮增生（C对），有过度正角化或过度不全角化，或两者同时出现为混合角化。上皮单纯性增生是良性病变，除上皮过度角化外还有粒层明显（B对）和棘层增生（A对），没有非典型细胞（D错，为本题正确答案）。上皮钉突虽伸长且变粗，但仍整齐，基底膜清晰。固有层和黏膜下层有淋巴细胞、浆细胞浸润。